某女，50岁。患脾虚乏力、食少便溏数年，近日又见血虚脏躁，神志不安。证属中气虚弱、血不养脏，治当补中益气，养血安神，宜选用的药是
A. 山药
B. 黄芪
C. 大枣
D. 红景天
E. 西洋参

正确答案：C。大枣

解析：本题考查的是大枣的功效。患脾虚乏力、食少便溏数年，近日又见血虚脏躁，神志不安。证属中气虚弱、血不养脏，治当补中益气，养血安神，宜选用的药是大枣（C对）。大枣：【功效】补中益气，养血安神，缓和药性。山药（A错）：【功效】益气养阴，补脾肺肾，固精止带。黄芪（B错）：【功效】补气升阳，益卫固表，托毒生肌，利水消肿。红景天（D错）：【功效】益气，平喘，活血通脉。西洋参（E错）：【功效】补气养阴，清热生津。